某男，45岁，症见阳痿不育，遗精早泄、腰痛、尿后余沥，证属肾虚精亏，宜选用的成药是
A. 左归丸
B. 济生肾气丸
C. 河车大造丸
D. 右归丸
E. 五子衍宗丸

正确答案：E。五子衍宗丸

解析：本题考查的是五子衍宗丸的主治。症见阳痿不育，遗精早泄、腰痛、尿后余沥，证属肾虚精亏，宜选用的成药是五子衍宗丸（E对）。五子衍宗丸：【主治】肾虚精亏所致的阳痿不育、遗精早泄、腰痛、尿后余沥。左归丸（A错）：【主治】真阴不足，腰酸膝软，盗汗遗精，神疲口燥。济生肾气丸（B错）：【主治】肾阳不足、水湿内停所致的肾虚水肿、腰膝酸重、小便不利、痰饮咳喘。河车大造丸（C错）：【主治】肺肾两亏，虚劳咳嗽，骨蒸潮热，盗汗遗精，腰膝酸软。右归丸（D错）：【主治】肾阳不足，命门火衰，腰膝酸冷，精神不振，怯寒畏冷，阳痿遗精，大便溏薄，尿频而清。